食品安全法规定，负责公布食品安全风险评估结果的行政机关是
A. 国务院质量监督部门
B. 国务院卫生行政部门
C. 中国疾病预防控制中心
D. 国务院食品药品监督部门
E. 国家食品安全风险评估中心

正确答案：B。国务院卫生行政部门

解析：本题考查负责公布食品安全风险评估结果的行政机关。食品安全法规定，负责公布食品安全风险评估结果的行政机关是国务院卫生行政部门（B对ACDE错）。